冠心苏合丸的使用注意事项有
A. 孕妇禁用
B. 胃溃疡患者慎用
C. 阴虚火旺者禁用
D. 肾脏疾病者慎用
E. 出血性疾患慎用

正确答案：A、B、D。孕妇禁用；胃溃疡患者慎用；肾脏疾病者慎用

解析：本题考查的是冠心苏合滴丸的注意事项。冠心苏合丸的使用注意事项有孕妇禁用（A对），胃溃疡患者慎用（B对）与肾脏疾病者慎用（D对）。冠心苏合滴丸：【注意事项】孕妇禁用。阴虚血瘀之胸痹者忌用。胃炎患者、胃弱患者、胃溃疡患者、食管炎患者及肾脏疾病患者慎用。其辛香走窜，易耗气伤阴，故不宜长期服用。服药期间，忌食生冷、辛辣、油腻食物，忌吸烟饮酒、喝浓茶。治疗期间，心绞痛持续发作，宜加用硝酸酯类药。如果出现剧烈心绞痛、心肌梗死等，应及时救治。据报道，服用本品有引起过敏性药疹和肾脏损害等不良反应，用时应注意。通心络胶囊：【注意事项】方中全蝎、蜈蚣、土鳖虫有毒，水蛭有小毒，故孕妇忌用，不宜多服、久服。出血性疾患、妇女月经期及阴虚火旺型中风禁用（CE错）。宜饭后服用。治疗期间，若心绞痛持续发作，应及时就诊救治。